卫生行政部门决定不予医师执业注册的，申请人有异议时
A. 只能申请复议
B. 只能向人民法院起诉
C. 可随时申请复议或向人民法院起诉
D. 可自收到通知之日起10日内申请复议或向人民法院起诉
E. 可自收到不予注册通知之日起15日内，申请复议或向人民法院起诉

正确答案：E。可自收到不予注册通知之日起15日内，申请复议或向人民法院起诉